经产妇，35岁，妊娠40周，规律宫缩8小时，近2小时产程无进展，静滴缩宫素后，产妇烦躁不安，腹痛加重，腹部拒按，出现病理缩复环，胎心90次/分，宫口扩张2cm，S-1，最可能的诊断是
A. 胎膜早破伴感染
B. 子宫破裂
C. 羊水栓塞
D. 重度胎盘早剥
E. 先兆子宫破裂

正确答案：E。先兆子宫破裂

解析：中青年经产妇，规律宫缩8小时，近2小时产程无进展（产程长）。静滴缩宫素后，产妇烦躁不安，腹痛加重，腹部拒按，出现病理缩复环（提示产程受阻，为先兆子宫破裂典型体征），胎心90次/分（正常110～160次/分，提示胎儿窘迫），据患者临床表现，体征及胎儿检测，最可能的诊断是先兆子宫破裂（E对）。子宫破裂（B错） 是直接威胁胎儿及孕妇生命的严重并发症，临床表现为产妇突感下腹撕裂样剧痛，子宫收缩骤然停止。腹痛稍缓和后，出现持续性腹膜刺激征，并伴有低血容量休克征象。羊水栓塞（C错）表现为突然出现的肺动脉高压、低氧血症及弥散性血管内凝血(DIC），又以DIC为主要典型临床表现（P209）。胎盘早剥临床表现是阴道流陈旧不凝血（特征性表现）、腹痛，可伴有子宫张力增高和子宫压痛，尤以胎盘剥离处最明显。重度胎盘早剥（D错）产妇有休克，可伴DIC。